制成固体分散物后具有肠溶作用的载体材料有
A. CAP
B. PVA
C. EC
D. Eudragit L
E. PVP

正确答案：A、D。CAP；Eudragit L

解析：本题考查片剂的包衣。醋酸纤维素酞酸酯（CAP）（A对）和丙烯酸树脂类（Eudragit S、Eudragit L）（D对）为肠溶性载体；聚乙烯醇（PVA）（B错）为水溶性，可为成膜剂；乙基纤维素（EC）（C错）为水不溶性载体；聚乙烯聚吡咯烷酮（PVP）（E错）为水溶性载体。